卡介苗的初种年龄是
A. 2个月
B. 3个月
C. 出生时
D. 8个月
E. 1岁

正确答案：C。出生时

解析：卡介苗接种是预防小儿肺结核的重要措施，而新生儿接种卡介苗的时间为出生后3天（C对）。